肾上腺皮质肿瘤引起的库欣综合征与库欣病鉴别，最有意义的试验检查是
A. 血皮质醇昼夜节律
B. 24小时尿17-羟类固醇
C. 过夜地塞米松抑制试验
D. 小剂量地塞米松抑制试验
E. 大剂量地塞米松抑制试验

正确答案：E。大剂量地塞米松抑制试验

解析：肾上腺皮质肿瘤引起的库欣综合征不依赖腺垂体分泌的ACTH作用，可自主分泌皮质醇，且不受下丘脑（CRF）-腺垂体（ACTH）-肾上腺皮质（皮质醇）轴的调控。库欣病则为腺垂体分泌ACTH增多引起的继发性肾上腺皮质分泌皮质醇增多。地塞米松为人工合成的糖皮质激素中生物作用最强的激素之一，仅需要很小的剂量即能达到与天然皮质醇相似的作用。使用小剂量（0.5mg）地塞米松可抑制正常人的皮质醇分泌，血皮质醇测定值减少，而库欣综合征却不受影响。因此小剂量地塞米松抑制试验（D错）可用于诊断库欣综合征，但无法鉴别库欣综合征的病因。加大地塞米松剂量（2mg），可抑制库欣病腺垂体分泌ACTH，从而使血浆皮质醇浓度有所降低。但肾上腺皮质肿瘤由于可自主分泌皮质醇，因此血浆皮质醇浓度并不受影响。故大剂量地塞米松试验（E对）可用于鉴别肾上腺皮质肿瘤引起的库欣综合征与库欣病。肾上腺皮质肿瘤引起的库欣综合征与库欣病均存在皮质醇增多、血皮质醇昼夜节律失常（A错）、24小时尿17-羟类固醇升高（B错）。过夜地塞米松抑制试验（C错）即一次口服地塞米松法与小剂量地塞米松抑制试验（D错）类似，均可用于库欣综合征的诊断，却无法用于鉴别诊断。